高钾血症的常见原因是
A. 挤压综合征
B. 长期饥饿状态
C. 反复呕吐
D. 盐皮质激素过多
E. 长期胃肠减压

正确答案：A。挤压综合征

解析：高钾血症是指血清钾浓度高于5.5mmol/L，由于正常人体内的钾离子90%存在于细胞内，仅有约1.4%存在于细胞外，因此当发生细胞、组织损伤时，如挤压综合征（A对），钾离子将顺浓度梯度自破损的细胞内流出至细胞外液，使血清钾浓度升高形成高钾血症。长期饥饿状态（B错）将因为钾的摄入不足引起低钾血症。反复呕吐（C错）和长期胃肠减压（E错）均可使富含钾离子的消化液丢失导致低钾血症。盐皮质激素过多（D错）可促使肾的保钠排钾功能增强可使钾离子的排出增加，从而导致低钾血症。